可用于治疗阿米巴肝脓肿的药是
A. 氯喹
B. 奎宁
C. 伯氨喹
D. 乙胺嘧啶
E. 甲氟喹

正确答案：A。氯喹

解析：氯喹能够杀灭阿米巴滋养体。由于其在肝脏内的浓度高，故可用于治疗阿米巴肝脓肿的抗肠道外阿米巴病作用。掌握“氯喹、青蒿素、伯氨喹及乙胺嘧啶”知识点。